反映人群健康状况较为敏感的指标是
A. 人群期望寿命
B. 出生率
C. 死亡率
D. 婴儿死亡率
E. 患病率

正确答案：D。婴儿死亡率